麻子仁丸适用于
A. 阴虚便秘
B. 血虚便秘
C. 阳虚便秘
D. 气虚便秘
E. 胃热津枯便秘

正确答案：E。胃热津枯便秘

解析：麻子仁丸用于胃热津枯便秘。本方因肠胃燥热，津液不足所致，功用润肠泄热，行气通便，为治疗胃肠燥热，脾津不足之“脾约”证的常用方（E对）。阴虚便秘方用六味地黄丸（A错）。血虚便秘方用润肠丸（B错）。阳虚便秘方用济川煎（C错）。气虚便秘方用黄芪汤（D错）。